开放式问题的优点是
A. 回答者能充分发表自己的看法
B. 节省时间
C. 节省精力
D. 易于数据整理分析
E. 适用于答案较少的情况

正确答案：A。回答者能充分发表自己的看法